不属于骨折治疗原则的做法是
A. 手法复位小夹板固定
B. 手术复位钢板内固定
C. 促进骨折愈合药物治疗
D. 指导病人做肌肉舒缩锻炼
E. 骨折复位后施以管型石膏

正确答案：C。促进骨折愈合药物治疗

解析：复位、固定和康复治疗是骨折的三大治疗原则。复位是将移位的骨折端恢复正常或近乎正常的解剖关系。固定是将骨折维持在复位后的位置，使其在良好对位的情况下达到牢固愈合，如手法复位小夹板固定（A对）、手术复位钢板内固定（B对）、骨折复位后施以管型石膏（E对）。康复治疗是在不影响固定的情况下，尽快地恢复患肢软组织的舒缩活动，如指导病人做肌肉舒缩锻炼（D对）。骨折愈合有其自身规律，不要求使用促进骨折愈合的药物治疗（C错，为本题正确答案）。